李某女性，患慢性乙型肝炎10年，血化验：HBsAg（+）、HBeAg（+）、抗-HBcIgG（+）。其3岁女儿体检时血清抗-HBs（+），追问病史，无任何临床症状，未注射乙肝疫苗，李某女儿属于
A. 隐性感染
B. 潜伏性感染
C. 显性感染
D. 病毒携带状态
E. 垂直感染

正确答案：A。隐性感染

解析：垂直感染（E错）也称母婴传播，一般为婴幼儿的传播途径。隐性感染是指病原体侵入人体后，仅引起机体产生特异性的免疫应答，不引起或只引起轻微的组织损伤，因而在临床上不显出任何症状、体征，甚至生化改变，只能通过免疫学检查才能发现，本例患者女儿无任何临床症状，在未注射乙肝疫苗的情况下血清抗-HBs（+），表明已产生保护性抗体，此为典型的隐性感染（A对），可以确诊。母亲HBsAg（+）、抗-HBcIgG（+）反映现症感染，HBeAg（+）反映病毒复制活跃且传染性较强，故不能就此诊断其女儿是垂直感染还是其他途径传播所致。隐性感染是指患者感染过程的表现，垂直感染是指感染的传播途径，两者强调的重点不同。潜伏性感染（B错）、显性感染（C错）、病毒携带状态（D错）均不符合本例患儿的化验情况。